男孩，3岁，自幼人工喂养，食欲极差，有时腹泻。身高85cm，体重7500g。皮肤干燥苍白，腹部皮下脂肪厚度约0.3cm。脉搏缓慢，心音较低钝。其主要诊断应是
A. 先天性甲状腺功能减低症
B. 营养性贫血
C. 婴幼儿腹泻
D. 营养不良
E. 心功能不全

正确答案：D。营养不良

解析：正常3岁儿童（P9）体重应达到14kg，身高达到95cm，题中小儿体重比正常体重减轻超过40%，应诊断为营养不良（D对）。先天性甲状腺功能减低症（P403）（A错）通常表现为腹胀、便秘等。营养性贫血（P326）（B错）则通常有心率脉搏增快，甚至出现心衰表现。长期的婴幼儿腹泻（P226）（C错）是引起营养不良病因之一。作为诊断，D选项更准确。小儿心功能不全（E错）症状与成人相似，主要为乏力、活动后气急，安静时心率、脉搏增快，呼吸浅快。